钟状期牙胚釉结向外釉上皮走行的一条细胞条索，似乎将成釉器一分为二的是
A. 无釉柱釉质
B. 釉板
C. 釉索
D. 釉龛
E. 釉结

正确答案：C。釉索

解析：本题考查成釉器的发育。钟状期牙胚釉结由内釉上皮向外釉上皮走行的一条细胞条索是釉索（C对）。无釉柱釉质（A错）和釉板（B错）为牙体硬组织结构。在切片观察帽状期成釉器时，釉龛为充填于牙板凹凸不平的薄层结构中的结缔组织（D错）。帽状期牙胚中央，内釉上皮局部的增厚为釉结（E错），呈簇状的未分化上皮细胞。